工程项目对大气环境影响评价方法中，对污染物扩散状况进行预测时，如污染物为点源排放，其评价区范围一般取其烟囱或排毒塔等几何高度的多少倍距离作为评价半径
A. 50～60倍
B. 60～70倍
C. 30～40倍
D. 20～30倍
E. 10～20倍

正确答案：C。30～40倍

解析：本题考查污染物为点源排放的评价区范围。工程项目对大气环境影响评价方法中，对污染物扩散状况进行预测时，如污染物为点源排放，其评价区范围一般取其烟囱或排毒塔等几何高度的30～40倍距离（C对ABDE错）作为评价半径。